生用镇静安神，煅用能收湿敛疮的是
A. 磁石
B. 龙骨
C. 滑石
D. 朱砂
E. 琥珀

正确答案：B。龙骨

解析：本题考查的是龙骨的性能特点。生用镇静安神，煅用能收湿敛疮的是龙骨（B对）。龙骨：【性能特点】本品介类质重镇潜，甘涩微寒收敛，入心、肝经，生用、煅用性效有别。生用微寒质重镇潜，长于镇惊安神、平肝潜阳，治心神不安、肝阳上亢常用。煅后平而涩敛，内服收敛固脱，治滑脱之证每投；外用收湿敛疮，治湿疹、湿疮可选。磁石（A错）：【性能特点】本品咸寒质重，沉降下行，镇坠与补益并举。入肝、心经，善镇惊安神、平肝潜阳，治心悸失眠、阳亢眩晕。入肾经，能益肾而聪耳明目、纳气平喘，治肾虚耳鸣、耳聋、目昏、喘促。滑石（C错）：【性能特点】本品甘淡寒清滑利，入膀胱、肺、胃经。内服清利，既清膀胱湿热而利尿通淋，为治湿热淋痛之良药；又清解暑热，为治暑湿、湿温之佳品。外用清敛，能清热、收湿敛疮，治湿疮、湿疹常用。朱砂（D错）：【性能特点】本品甘寒清解，质重镇怯，有毒而力强，专入心经。善重镇安神，为治心火亢盛诸证之要药，无论虚实皆宜；能清热解毒，为治热毒疮肿、咽痛、口疮所常用。琥珀（E错）：【性能特点】本品重镇行散，甘淡渗利，平而偏凉。入心、肝经，善安神定惊、活血散瘀，既治惊悸失眠、惊风癫痫，又疗血滞闭经、癥瘕积聚；入膀胱经，能利尿通淋，治小便不利、癃闭诸证。